以下哪项不是痰饮的致病特点
A. 阻滞气血运行
B. 影响水液代谢
C. 易于蒙蔽心神
D. 致病广泛，变幻多端
E. 病位固定，病证繁多

正确答案：E。病位固定，病证繁多

解析：痰饮的致病特点为阻滞气血运行（A对），影响水液代谢（B对），易于蒙蔽心神（C对），致病广泛，变幻多端（D对）。病位固定，病证繁多为瘀血致病特点（E错，为本题正确答案）。